经血液传播的病毒性肝炎有
A. 甲型肝炎、乙型肝炎、丙型肝炎
B. 甲型肝炎、乙型肝炎、丁型肝炎
C. 乙型肝炎、丙型肝炎、丁型肝炎
D. 甲型肝炎、乙型肝炎、戊型肝炎
E. 乙型肝炎、丁型肝炎、戊型肝炎

正确答案：C。乙型肝炎、丙型肝炎、丁型肝炎